关于强心苷中毒后的抢救，错误的是
A. 轻度中毒者停药即可
B. 快速型心律失常轻者可口服氯化钾
C. 室性早搏心动过速补钾+苯妥英钠
D. 房室传导阻滞用普萘洛尔
E. 危及生命的静脉注射地高辛抗体Fab片段

正确答案：D。房室传导阻滞用普萘洛尔

解析：识别强心苷的中毒先兆并及时停药，对于防止严重中毒反应的发生十分重要。1.预防：低血K⁺、低血Mg²⁺、高血Ca⁺、心肌缺氧和肾功能低下等均是强心苷中毒的诱发因素，用药过程中需加以注意。患者一旦出现中毒先兆症状，如室性早搏、窦性心动过缓（低于60次/分钟）、视色障碍等，都应及时减量或停药（A对），并停用排钾利尿药和肾上腺皮质激素类药物。2.治疗：首先应停用强心苷。对于表现为快速型心律失常的中毒患者，应及时补钾（B对），可选用苯妥英钠（C对），与强心苷竞争Na⁺-K⁺-ATP酶，控制期前收缩并减慢房室传导。对于室性心律失常，还可选用利多卡因解救。对于极其严重的地高辛中毒患者，可静脉注射地高辛抗体Fab片段（E对），与地高辛结合后，解除其对Na⁺-K⁺-ATP酶的抑制作用而迅速缓解药物的毒性反应。对于窦性心动过缓或传导阻滞者，可用阿托品治疗（D错，为本题正确答案）。